室内吸烟污染状况评价
A. 一氧化碳
B. 二氧化硫
C. 细菌总数
D. 二氧化碳
E. 甲醛

正确答案：A。一氧化碳

解析：本题考查评价居室空气清洁度常用的指标。一氧化碳（A对BCDE错）可用于评价室内吸烟污染状况，当室内一氧化碳浓度过高时，会对人体健康产生危害。